71岁男性，二年来无诱因逐渐出现行动缓慢，行走时上肢无摆动，前倾屈曲体态。双手有震颤，双侧肢体肌张力增高。无智能和感觉障碍，无锥体束损害征。最可能的诊断是
A. 帕金森病
B. 扭转痉挛
C. 阿尔茨海默（Alzheimer）病
D. 肝豆状核变性
E. 脑动脉硬化

正确答案：A。帕金森病

解析：帕金森病是一种常见的中老年神经系统变性疾病，临床变现为静止性震颤、运动迟缓、肌强直和姿势平衡障碍为主要特征。本例患者老年男性，二年来无诱因逐渐出现行动缓慢，行走时上肢无摆动（肌强直表现），前倾屈曲体态（姿势平衡障碍表现），双手有震颤，双侧肢体肌张力增高。诊断为帕金森病（A对）。扭转痉挛（B错）青年人多见，表现为以躯干为轴的全身性扭转或螺旋样运动。阿尔茨海默病（C错）临床上表现为记忆障碍、失语、失用、失认、视空间能力损害、抽象思维和计算力损害、人格和行为改变等（P219）。肝豆状核变性（D错）有椎体外系损害症状，有肢体舞蹈样及手足徐动样动作（有上肢摆动），还有精神症状及肝功能受损表现（P286）。脑动脉硬化（E错）会因脑血供不足而导致注意力不集中、记忆力减退、情绪不稳、思维迟缓等神经衰弱综合征，可有智能障碍。